低血糖发生风险较高的口服降糖药物是
A. 沙格列汀
B. 达格列净
C. 吡格列酮
D. 二甲双胍
E. 瑞格列奈

正确答案：E。瑞格列奈

解析：本题考查口服降糖药。低血糖发生风险较高的口服降糖药物是瑞格列奈（E对）。单用即可引起低血糖的是胰岛素促泌剂。瑞格列奈属于非磺酰脲类胰岛素分泌促进剂，吸收快、起效快。沙格列汀（A错）为二肽基肽酶-4（DPP4）抑制剂，单独使用不增加低血糖发生的风险。达格列净（B错）属于钠-葡萄糖协同转运蛋白-2（SGLT-2）抑制药，SGLT-2抑制剂的常见不良反应为生殖泌尿道感染。吡格列酮（C错）属于噻唑烷二酮类胰岛素增敏剂，不良反应常见贫血、血红蛋白降低、血容量增加、血细胞比容降低、血红蛋白降低。二甲双胍（D错）为双胍类口服降糖药，常见腹泻、腹痛、食欲减退、胃胀等。